一男性，某省厅干部，平时不嗜烟酒，生活规律；但性情急躁，易激动，工作认真，争强好胜，雄心勃勃。1年前单位减员时调人某厂工作，常因小事上火，发脾气。3日前因心绞痛人院，诊断为冠心病。病人的情绪反应属于
A. 抑郁反应
B. 恐怖反应
C. 厌恶反应
D. 愤怒反应
E. 以上都不是

正确答案：E。以上都不是